女，60岁，慢性咳喘20年，剧烈咳嗽3天，无咳痰、咯血及发热，半小时前突发胸痛，呼吸困难，不能平卧，伴发绀。体检：血压150/100mmHg，呼吸40次/分。右胸语颤减弱，呼吸音减低。心率110次/分。以上表现符合
A. 肺梗死
B. 急性心肌梗死
C. 急性左心衰竭
D. 阻塞性肺气肿
E. 自发性气胸

正确答案：E。自发性气胸

解析：患者为老年女性，咳嗽咳痰20年，应诊断患者存在慢性阻塞性肺气肿（COPD），COPD患者突发胸痛，呼吸困难，不能平卧，伴发绀，右胸语颤减弱，呼吸音减低，应考虑并发了自发性气胸（E对）。阻塞性肺气肿（D错）为基础病，不是患者发生胸痛及呼吸困难等急症的病因，故应排除。肺梗死（P99）（A错）为肺动脉栓塞后，其支配区肺组织因血流中断而发生坏死，临床表现为呼吸困难、胸痛及咯血肺梗死三联征，体检时可发现病变部位语颤增强，与患者表现不符，故应排除。急性心肌梗死（P236）（B错）临床表现为胸骨后压榨性疼痛、发热、心动过速、频繁恶心、呕吐和上腹部胀痛，严重者可见低血压、休克，而患者血压升高，与其表现不符，故应排除。急性左心衰竭（P174）（C错）表现为突发严重呼吸困难，强迫坐位呼吸，咳粉红色泡沫样痰，而该患者未有咳粉红色泡沫痰的表现，与其表现不符，故应排除。